下列各项，不属于外科疾病成脓期的特点的是
A. 疼痛剧烈呈鸡啄样
B. 皮肤肿胀，皮薄光亮
C. 局部皮肤瘙痒
D. 局部皮肤温度增高
E. 肿块变软

正确答案：C。局部皮肤瘙痒

解析：疼痛：阳证疮疡，因正邪交争剧烈，脓液积聚，脓腔张力不断增高，压迫周围组织而疼痛剧烈。局部按之灼热痛甚，拒按明显；年老体弱者应激力差，反应迟钝，痛感缓和；阴证脓疡则痛热不甚而酸胀明显。（A错）肿胀：皮肤肿胀，皮薄光亮为有脓。（B错）温度：用手仔细触摸患部，与周围正常皮肤相比，若为阳证疮疡，则局部温度增高。（D错）硬度：肿块已软为脓已成。（E错）局部皮肤瘙痒往往见于疮疡初起。（C对）